关于医疗机构制剂的界定及特征的说法，错误的是
A. 需要取得《医疗制剂许可证》和药品批准文号
B. 仅限于本单位临床使用而市场上没有供应的品种
C. 特定情况下，麻醉药品可以作为医疗机构制剂品种审核
D. 只能由医院的药学部门配制，其他科室不得配制供应

正确答案：A。需要取得《医疗制剂许可证》和药品批准文号

解析：本题考查医疗机构制剂注册制度。医疗机构配制的中药制剂品种，应当依法取得制剂批准文号。但是，仅应用传统工艺配制的中药制剂品种，向医疗机构所在地省级药品监督管理部门备案后即可配制，不需要取得制剂批准文号（A错，为本题正确答案）。医疗机构配制的制剂，应当是本单位临床需要而市场上没有供应的品种（B对）。在特殊情况下，经国家或者省（区、市）药品监督管理部门批准，医疗机构配制的制剂可以在规定的期限内、在指定的医疗机构之间调剂使用（C对）。其他科室或者部门不得从事药品的采购、调剂活动，不得在临床使用非药学部门采购供应的药品（D对）。